一初产妇，宫缩15小时自娩一3000g女婴，现胎儿娩出已8分钟，胎盘尚未娩出，阴道无流血，此时的处理下列何项不当
A. 查看子宫形态
B. 经肌肉注射催产素
C. 察看外露脐带有否向外伸长
D. 牵拉脐带或压迫宫底以了解胎盘是否剥离
E. 等待观察有胎盘剥离征象时协助胎盘娩出

正确答案：D。牵拉脐带或压迫宫底以了解胎盘是否剥离

解析：患者胎儿娩出已8分钟，胎盘尚未娩出，阴道无流血，此时的处理不当的是：牵拉脐带或压迫宫底以了解胎盘是否剥离（D错，为本题正确答案）。子宫形态异常容易引起早产、流产（A对）。催产素在分娩过程中促进子宫平滑肌的收缩（B对）。外露脐带有向外伸长，表明胎盘剥离（C对）。有胎盘剥离时，产妇易发生大出血、休克，应终止妊娠（E对）。